促进胰岛素分泌的药物是
A. 罗格列酮
B. 吡格列酮
C. 阿卡波糖
D. 格列齐特
E. 二甲双胍

正确答案：D。格列齐特

解析：格列齐特（D对）属于磺酰脲类，可刺激胰岛B细胞释放胰岛素（D对），与胰岛B细胞膜上磺酰脲受体结合后，可阻滞与受体相偶联的ATP敏感钾通道而阻止钾外流，增加电压依赖性钙通道开放，促进细胞外钙内流，胞质内游离钙浓度增加后，可触发胰岛素的释放。罗格列酮、吡格列酮是胰岛素增敏剂（AB错），改善B细胞功能，显著改善胰岛素抵抗及相关代谢紊乱，对2型糖尿病及其心血管并发症均有明显疗效。阿卡波糖（C错）是α-葡萄糖苷酶抑制剂，主要减慢碳水化合物水解及产生葡萄糖的速度并延缓葡萄糖的吸收。二甲双胍（E错）作用机制可能是促进脂肪组织摄取葡萄糖，降低葡萄糖在肠的吸收及糖原异生等而降低血糖。